治疗痰湿中阻之眩晕的主方应选
A. 二陈汤
B. 半夏白术天麻汤
C. 天麻钩藤饮
D. 异功散
E. 参苓白术丸

正确答案：B。半夏白术天麻汤

解析：半夏白术天麻汤是治疗痰湿蒙蔽清窍导致头痛、眩晕的首选方（B对）。二陈汤为祛痰剂，具有燥湿化痰，理气和中之功效。主治湿痰证，咳嗽痰多，色白易咯，恶心呕吐，胸膈痞闷，肢体困重，或头眩心悸，舌苔白滑或腻，脉滑。临床常用于治疗慢性支气管炎、慢性胃炎、梅尼埃病、神经性呕吐等属湿痰者（A错）。天麻钩藤饮主治肝阳上亢型眩晕，症见眩晕耳鸣，头胀痛，急躁易怒，失眠多梦。兼有腰膝酸软，健忘遗精等（C错）。异功散主要功效为益气补中，理气健脾；主治脾虚气滞、饮食减少、胸脘痞闷、食入作胀、大便溏薄、神疲气短、身体羸瘦、或面部浮肿者（D错）。参苓白术丸可健脾、益气。用于体倦乏力，食少便溏（E错）。